关注所有人群的调查问卷属于
A. 疾病专门化问卷
B. 一般健康问卷
C. 部位专门化问卷
D. 治疗问卷
E. 以上都不是

正确答案：B。一般健康问卷